属于国家二级保护野生药材物种的是
A. 赛加羚羊
B. 甘草
C. 龙胆
D. 洋金花
E. 罂粟

正确答案：B。甘草